蜂蜜贮久或遇冷析出的白色颗粒状结晶，其成分是
A. 葡萄糖
B. 果糖
C. 蔗糖
D. 麦芽糖
E. 木糖

正确答案：A。葡萄糖

解析：本题考查的是蜂蜜结晶成分。蜂蜜贮久或遇冷析出的白色颗粒状结晶，其成分是葡萄糖（A对）。蜂蜜结晶是蜂蜜的一种自然现象。蜂蜜的结晶，实质上是葡萄糖从蜂蜜中析出被分离的一种现象和过程。